关于乳尖牙的解剖特点叙述正确的是
A. 上颌乳尖牙唇面牙尖短小
B. 远中牙尖嵴长于近中牙尖嵴
C. 牙尖偏向近中
D. 牙尖偏移方向与恒尖牙相同
E. 单根细长并向唇侧弯曲

正确答案：E。单根细长并向唇侧弯曲

解析：本题考查乳尖牙的解剖特点。上下颌乳尖牙根尖均为细长单根，偏向唇侧（E对），弯向远中。上颌乳尖牙牙尖长大（A错），约为牙冠长度的一半，近中斜缘长于远中斜缘（B错），牙尖偏远中（C错），为上颌乳尖牙主要的解剖特征，牙尖与恒尖牙牙尖偏移方向相反（D错），恒尖牙牙尖均偏近中。下颌乳尖牙牙冠与上颌相似，但远中斜缘长于近中斜缘，牙尖偏近中。